二度Ⅰ型房室传导阻滞的心电图特征是
A. P-R间期进行性缩短，直至一个P波受阻不能下传到心室
B. 相邻R-R间距进行性延长，直至一个P波受阻不能下传到心室
C. P-R间期进行性延长，直至一个P波受阻不能下传到心室
D. P-R间期＞0.20秒，P波无受阻
E. P-R间期固定，P波间断受阻不能下传到心室

正确答案：C。P-R间期进行性延长，直至一个P波受阻不能下传到心室

解析：二度Ⅰ型房室传导阻滞的心电图特征是，P波规律地出现，P-R间期进行性延长，直至一个P波受阻不能下传到心室（C对AB错）。P-R间期＞0.20秒，P波无受阻（D错）为一度房室传导阻滞。P-R间期固定，P波间断受阻不能下传到心室（E错）为二度Ⅱ型房室传导阻滞。